10个月婴儿，11月3日发生腹泻，大便呈蛋花汤样，无腥臭味，每天约10次，持续3天。体温37.5～38℃，偶有咳嗽，尿量偏少。查体：体重10kg，皮肤稍干燥，眼窝稍凹陷，皮肤弹性可，粪常规未见异常。为明确脱水性质，应做的检查是
A. 血常规
B. 尿常规
C. 血气分析
D. 血钾、钠、氯
E. 肝、肾功能

正确答案：D。血钾、钠、氯